属于一类医疗器械产品的是
A. 一次性使用无菌注射器
B. 煮沸消毒器
C. 体重秤
D. 婴儿奶瓶
E. 医用脱脂棉

正确答案：B。煮沸消毒器